关于药物制成混悬剂的条件的正确表述有
A. 难溶性药物需制成液体制剂供临床应用时
B. 药物的剂量超过溶解度而不能以溶液剂形式应用时
C. 两种溶液混合时药物的溶解度降低而析出固体药物时
D. 毒剧药或剂量小的药物不应制成混悬剂使用
E. 需要产生缓释作用时

正确答案：A、B、C、D、E。难溶性药物需制成液体制剂供临床应用时；药物的剂量超过溶解度而不能以溶液剂形式应用时；两种溶液混合时药物的溶解度降低而析出固体药物时；毒剧药或剂量小的药物不应制成混悬剂使用；需要产生缓释作用时